霍乱的典型临床特征是
A. 发热、腹痛、腹泻
B. 无痛腹泻、脱水、周围循环衰竭
C. 剧烈呕吐、腹泻、昏迷
D. 腹痛腹泻、里急后重、神志改变
E. 腹泻、休克

正确答案：B。无痛腹泻、脱水、周围循环衰竭